患者，男，58岁，高血压病史5年；吸烟史40年，日均40支。6小时前出现左侧肢体无力，并逐渐加重，不能站立；家属发现其说话迟钝，言语含混，右侧嘴唇变浅；意识清楚。到某院急诊，BP190/120mmHg；血常规基本正常，行头部MRI检查后，诊断为急性脑梗死。治疗过程中患者出现颅内压升高，此时应用的治疗方案是
A. 呋塞米片200mg qd po
B. 胞磷酸胆碱注射液200mg iv
C. 甘露醇注射液250ml q6h iv
D. 尼莫地平注射液200mg qd iv
E. 依达拉奉注射液30mg bid iv

正确答案：C。甘露醇注射液250ml q6h iv

解析：本题考查药物的用法。由题可知：治疗过程中患者出现颅内压升高，此时的治疗方案是应用甘露醇注射液250ml q6h iv（C对）进行脱水治疗。甘露醇注射液静脉滴注可用于各种原因的脑水肿、颅内压增高和青光眼。呋塞米片（A错）用于颅内压升高，充血性心力衰竭，肝硬化，肾脏疾病，高血压危象，高钾血症，高钙血症，与其它药物合用治疗急性肺水肿和急性脑水肿等。胞磷酸胆碱注射液（B错）为脑代谢激活剂。尼莫地平注射液（D错）适用于各种原因的蛛网膜下隙出血后的脑血管痉挛和急性脑血管病恢复期的血液循环改善。依达拉奉注射液（E错）用于改善急性脑梗死所致的神经症状、日常生活活动能力和功能障碍。